10个月男孩，母乳喂养，刚开始添加辅食，食欲差，偏食。查体：皮肤弹性尚可，腹部皮下脂肪减少，体重低于同年龄同性别儿童均值减2个标准差。预防该儿童营养不良的正确措施是
A. 多吃水果
B. 多吃蔬菜
C. 满3个月添加辅食
D. 满6个月添加辅食
E. 一岁内体检1～2次

正确答案：D。满6个月添加辅食

解析：本题考查预防婴幼儿营养不良的措施。该患儿10个月刚开始添加辅食，因添加过晚而致能量不足，故预防该患儿营养不良的正确措施是满6个月添加辅食（D对ABCE错）。预防婴幼儿营养不良最主要的措施：科学喂养和合理营养，包括纯母乳喂养儿满6个月添加辅食，多吃动物性食物，定期体检尽早发现并进行干预等。